主要成分为砷类化合物，具有原浆毒作用，可引起肝肾损伤的中药是
A. 雄黄
B. 黄丹
C. 朱砂
D. 轻粉
E. 硫黄

正确答案：A。雄黄

解析：本题考查的是雄黄的化学成分。主要成分为砷类化合物，具有原浆毒作用，可引起肝肾损伤的中药是雄黄（A对）。雄黄为含砷矿物药。含砷矿物药能引起肾损伤：包括砒石、雄黄、代赭石等，其毒性成分主要是三氧化二砷（As₂O₃），即砒霜，其原浆毒作用可抑制含巯基酶活性，使肝脂肪变性，肝小叶中心坏死，心、肠充血，上皮细胞坏死。矿物类中药按阳离子分类法分类：朱砂（C错）、轻粉（D错）、红粉等为汞化合物类；磁石、自然铜、赭石等为铁化合物类；石膏、钟乳石、寒水石等为钙化合物类；雄黄、雌黄、信石等为砷化合物类；白矾、赤石脂等为铝化合物类；胆矾、铜绿等为铜化合物类；密陀僧、铅丹等为铅化合物类；芒硝、硼砂、大青盐等为钠化合物类；滑石为镁化合物类。黄丹（B错）主要成分为四氧化三铅。硫黄（E错）：【来源】为自然元素类矿物硫族自然硫；或用含硫矿物经加工制得。主含硫（S）。